下列药品中应按麻醉药品管理的有
A. 氨酚待因片
B. 磷酸可待因片
C. 盐酸二氢埃托啡片
D. 福尔可定片
E. 盐酸丁丙诺啡片

正确答案：B、C、D。磷酸可待因片；盐酸二氢埃托啡片；福尔可定片

解析：本题考查麻醉药品管理。磷酸可待因片（B对）、盐酸二氢埃托啡片（C对）和福尔可定片（D对）应按麻醉药品管理。依据《麻醉药品和精神药品管理条例》中规定，麻醉药品和第一类精神药品不得零售。磷酸可待因片可用于局麻或全麻、盐酸二氢埃托啡片仅限用于创伤、手术后诊断明确的各种剧烈疼痛、福尔可定片适用于中等程度疼痛，以上三种均属于麻醉性镇痛药；氨酚待因片（A错）为中等强度镇痛药，属于非麻醉性镇痛药；盐酸丁丙诺啡片（E错）适用于强效镇痛药，用于各类手术后疼痛和癌症疼痛，不属于麻醉性镇痛药。